某药品零售连锁企业经批准可以从事第二类精神药品零售活动，关于其从事购销、配送第二类精神药品活动的说法，错误的是
A. 该企业采购第二类精神药品需由供货单位将药品送达注册的仓库地址，不允许自提
B. 该企业对其所属的经营第二类精神药品的门店应执行统一进货、统一配送和统一管理
C. 该企业从第二类精神药品批发企业购进第二类精神药品时禁止使用现金进行交易
D. 该企业所属门店采购第二类精神药品，应委托具备精神药品配送资格的企业配送

正确答案：D。该企业所属门店采购第二类精神药品，应委托具备精神药品配送资格的企业配送

解析：本题考查麻醉药品和精神药品的销售配送要求。药品零售连锁企业门店所零售的第二类精神药品，应当由本企业直接配送，不得委托配送（D错，为本题正确答案）。麻醉药品和精神药品的销售配送要求：（1）全国性批发企业和区域性批发企业向医疗机构销售麻醉药品和第一类精神药品，应当将药品送至医疗机构。医疗机构不得自行提货。（2）企业销售出库的第二类精神药品不允许购货单位自提，须由供货企业将药品送达医疗机构库房或购买方注册的仓库地址（A对）。（3）药品零售连锁企业对其所属的经营第二类精神药品的门店，应当严格执行统一进货、统一配送和统一管理（B对）。药品零售连锁企业门店所零售的第二类精神药品，应当由本企业直接配送，不得委托配送。企业、单位之间购销麻醉药品和精神药品一律禁止使用现金进行交易（C对）。